产气性皮下蜂窝织炎多见于
A. 口腔及面部
B. 项部及背部
C. 四肢
D. 会阴部
E. 头皮

正确答案：D。会阴部

解析：急性蜂窝织炎由于病菌的种类与毒性、病人的病情及部位的不同，可分为产气性皮下蜂窝织炎、新生儿皮下坏疽及口底、颌下蜂窝织炎。产气性皮下织炎多以厌氧菌为主，见于皮肤破损且污染较重的部位，以会阴部（D对）多见。